会引起凝血功能障碍的药物是
A. 苯巴比妥
B. 地西泮
C. 苯妥英钠
D. 阿司匹林
E. 卡比多巴

正确答案：D。阿司匹林

解析：本题考查阿司匹林。阿司匹林（D对）可抑制血小板中COX-1，一般剂量抑制血小板的聚集，长期使用还可抑制凝血酶原生成，引起凝血功能障碍；苯巴比妥（A错）为镇静催眠药，常见的不良反应有嗜睡、精神依赖性、肌无力等；地西泮（B错）为苯二氮䓬类镇静催眠药，其不良反应主要为中枢神经系统症状；苯妥英钠（C错）为抗癫痫药，不良反应为行为改变、笨拙或步态不稳等；卡比多巴（E错）为抗帕金森病药物，不会引起凝血功能障碍。